含氯塑料在加热或者焚烧时会产生
A. 二噁英
B. 多氯联苯
C. 苯并（a）芘
D. 喹噁啉类
E. 氯乙烯

正确答案：A。二噁英

解析：本题考查含氯塑料在加热或者焚烧时产生的物质。含氯塑料在加热和作为垃圾焚烧时会产生二噁英（A对BCDE错）。